患者男，50岁。有大量吸烟史20年，咳嗽痰中带血近1月。现可见四肢关节疼痛及杵状指，X线显示右肺上叶肺不张，应首先考虑的诊断是
A. 甲状腺功能亢进症
B. 慢性支气管炎阻塞性肺气肿
C. 支气管扩张
D. 肺结核
E. 肺癌

正确答案：E。肺癌

解析：患者有吸烟史20年，且咳嗽痰中带血，肺癌早期无症状，当病情发展到一定程度时，常出现刺激性干咳，痰中带血或血痰，胸痛，发热，气促等，会出现相关阳性体征，如杵状指，且X线显示综合判断为肺癌（E对）。甲状腺功能亢进症临床上以甲状腺肿大，食欲亢进，形体消瘦，体重减轻，心动过速，情绪激动，怕热汗出，手指颤抖，突眼等症状为主要表现（A错）。慢性支气管炎阻塞性肺气肿症见气急，活动后加重，伴有肺气肿的体征，如桶状胸，肺部叩诊呈过清音，X线检查示肺野透亮度增加（B错）。支气管扩张临床表现主要为慢性咳嗽、咳大量脓痰和（或）反复咯血，多见于儿童和青年（C错）。肺结核多呈慢性过程，以低热、盗汗、消瘦、乏力、食欲不振等全身中毒症状及咳嗽、咳痰、咯血、呼吸困难、胸痛等呼吸系统症状为主要表现（D错）。